木瓜的主产地是
A. 河南
B. 河北
C. 甘肃
D. 安徽
E. 吉林

正确答案：D。安徽

解析：本题考查的是木瓜的产地。木瓜的主产地是安徽（D对）。木瓜：【产地】主产于安徽、湖北、四川、浙江等省。以安徽宣城的宣木瓜质量最好。主产河南（A错）为怀药。如著名的“四大怀药”——地黄、牛膝、山药、菊花；以及天花粉、瓜蒌、白芷、辛夷、红花、金银花、山茱萸等。河北（B错）地道药材为板蓝根、白芷、柴胡、黄芩、紫菀等。甘肃（C错）地道药材有大黄、当归、秦艽等。吉林（E错）地道药材有人参、五味子、鹿茸等。